“三同时”属于
A. 日常劳动卫生业务
B. 经常性卫生监督
C. 事故性卫生监督
D. 预防性卫生监督
E. 职业病诊断与鉴定的监督

正确答案：D。预防性卫生监督